病情恢复后不发生病原携带状态的传染病是
A. 乙型肝炎
B. 甲型肝炎
C. 细菌性痢疾
D. 丙型肝炎
E. 伤寒

正确答案：B。甲型肝炎

解析：病原携带者即不显出临床症状而能排出病原体。许多传染性疾病中如伤寒（E错）、痢疾（C错）、霍乱、白喉、乙型肝炎（A错）、丙型肝炎（D错）等，病原携带者成为重要的传染来源。但并非所有传染病都有病原携带者，如麻疹、流感、甲型肝炎（B对）、戊型肝炎，病原携带者极为罕见。